女性，11岁，半天来突发右上腹钻顶样剧烈绞痛，伴恶心呕吐，间歇期完全缓解，腹软，无局限压痛，最可能诊断为
A. 急性胃炎
B. 急性胆囊炎
C. 胆道蛔虫症
D. 急性肝脓肿
E. 急性胰腺炎

正确答案：C。胆道蛔虫症

解析：患儿右上腹钻顶样剧烈绞痛间歇性发作（胆道蛔虫症典型症状），恶心、呕吐，腹软无压痛，根据临床表现及查体，最可能的诊断是胆道蛔虫症（C对）。急性胃炎（A错）不会出现钻顶样剧烈绞痛。急性胆囊炎（B错）常表现为阵发性右上腹绞痛，Murphy征阳性，即有局限压痛。急性肝脓肿（D错）常表现为右上腹持续性胀痛，畏寒发热，肝肿大。急性胰腺炎（E错）常表现为饱餐或饮酒后持续性上腹或左上腹疼痛，呕吐后腹痛不缓解，左上腹压痛明显。